化脓灸属于
A. 直接灸
B. 间接灸
C. 温和灸
D. 回旋灸
E. 实按灸

正确答案：A。直接灸

解析：化脓灸即瘢痕灸，直接灸分瘢痕灸和无瘢痕灸（A对）。间接灸有隔姜灸、隔盐灸、隔蒜灸、隔附子饼灸等（B错）。温和灸属于悬起灸（C错）。回旋灸属于悬起灸（D错）。实按灸包括太乙针灸和雷火针灸（E错）。